男，70岁。乏力、腰痛半个月。既往体健。查体：轻度贫血貌，第2～4腰椎局部压痛。实验室检查：Hb80g/L，WBC5.6×10⁹/L，Plt156×10⁹/L；血清总蛋白108g/L，白蛋白30g/L，血肌酐177umol/L；骨髓细胞学检查示骨髓中异常浆细胞占0.45；腰椎X线片示第2腰椎压缩性骨折。根据目前的临床资料及Durie和Salmon临床分期标准，该患者最可能的临床分期是
A. Ⅲ期B组
B. Ⅱ期A组
C. Ⅰ期B组
D. Ⅱ期B组
E. Ⅲ期A组

正确答案：A。Ⅲ期B组

解析：根据Durie和Salmon临床分期标准，多发性骨髓瘤分为3期。Ⅰ期：（1）血红蛋白＞100g/L；（2）血清钙≤3.0mmol/L；（3）骨X线摄片正常或仅有孤立病灶；（4）M–成分水平IgG＜50g/L，IgA＜30 g/L，尿轻链＜4g/24h；（5）体内瘤细胞总数＜0.6×10¹²/m²。Ⅱ期：介于Ⅰ期和Ⅲ期之间。Ⅲ期：（1）血红蛋白＜85g/L；（2）血清钙＞3.0mmol/L；（3）骨X线摄片为进展性溶骨性病变；（4）M–成分水平IgG＞70g/L，IgA＞50g/L，尿轻链＞12g/24h；（5）体内瘤细胞总数＜1.2×10¹²/m²。每期又分为A组和B组，A组肾功能正常（血肌酐＜176.8μmol/L）；B组肾功能损害（血肌酐＞176.8μmol/L）。该患者考虑为多发性骨髓瘤，Hb80g/L（＜85g/L），腰椎X线示L₂压缩性骨折，根据Durie和Salmon临床分期标准，应为Ⅲ期，患者血肌酐177μmol/L（＞176.8μmol/L），提示肾功能损害，应为B组，综合分析患者最可能的临床分期是Ⅲ期B组（A对）。